某女，32岁，平素性情急躁易怒，月经不调，因胃痛1周就诊，胃脘灼痛，痛势急迫，烧心泛酸，口苦口干，舌红苔黄，脉弦。该患者舌红提示属于
A. 虚寒证
B. 实热证
C. 虚热证
D. 瘀血证
E. 痰湿证

正确答案：B。实热证

解析：本题考查的是望舌色。该患者舌红提示属于实热证（B对）。望舌色：主要观察舌质颜色的异常变化，主要有以下四种。①淡白舌：较正常舌色浅淡，称为淡白舌。主虚寒证（A错），为阳气虚弱、气血不足之象。阳虚血少，气血不荣，故舌色淡白，常见于阳虚、血虚的病证。②红舌：舌色深于正常舌，称为红舌。主热证。热盛则气血涌甚，反映于舌质，故呈现红色。可见于里实热证，也可见于阴虚内热。③绛舌：舌色深红，称为绛舌。主内热深重。外感热病见绛舌，表示邪热深入营血，多见于热性病极期。内伤杂病中，绛舌常见于久病、重病之人，多属阴虚火旺。④紫舌：舌见紫色，主病有寒热之分，绛紫色深，干枯少津，多系邪热炽盛、阴液两伤、血气壅滞不畅之象；淡紫或青紫温润，多因阴寒内盛、血脉瘀滞所致。舌上有紫色斑点，称为瘀斑或瘀点，多为血瘀（D对）之象。虚热证（C错）的临床表现为颜部潮红。仅见颜面潮红，则多属阴虚而阳亢的虚热证。痰湿证（E错）的临床表现为舌体胖嫩，色淡。舌体胖嫩，色淡多属脾肾阳虚、津液不化、水饮痰湿阻滞所致。